下列哪种为产热营养素
A. 纤维素
B. 碳水化合物
C. 维生素
D. 水
E. 矿物质

正确答案：B。碳水化合物

解析：本题考查人体必需的营养素及能量。属于产热营养素的是碳水化合物（B对）。纤维素（A错）主要存在于蔬菜和粗加工的谷类中，虽然不能被消化吸收，但有促进肠道蠕动，利于粪便排出等功能，在保障人类健康，延长生命方面有着重要作用，因此被称为第七种营养素。维生素（C错）是指维持机体正常代谢和生理功能所必需的一类低分子有机化合物，属于非机体结构成分，不能提供能量，但具有特殊的代谢功能。水（D错）是体内一切生理过程中生物化学变化必不可少的介质，在新陈代谢过程中，人体内物质交换和化学反应都是在水中进行的。水不仅是体内生化反应的介质，而且水本身也参与体内氧化、还原、合成、分解等化学反应，水是各种化学物质在体内正常代谢的保证。矿物质（E错）指人体内除C、H、O、N以外的元素，其在体内的生理功能表现为：构成人体组织，如骨骼、牙齿中的钙、磷、镁；调节细胞膜的通透性，控制水分，维持细胞内外液的正常渗透压和酸碱平衡以及神经肌肉的兴奋性；构成酶、激素、维生素、蛋白质和核酸，参与酶的激活。